十二经脉的功能反应于体表的是
A. 十二经别
B. 十二经筋
C. 十五别络
D. 十二皮部
E. 奇经八脉

正确答案：D。十二皮部

解析：十二皮部（D对）是十二经脉功能活动反映于体表的部位，也是络脉之气在皮肤所散布的部位，由于十二皮部居于人体最外层，又与经络气血相通；十二经别（A错）是十二正经别行深入体腔的支脉，加强了表里两经在体内的联系；十二经筋（B错）的主要作用是约束骨骼，利于关节屈伸活动，以保持人体正常的运动功能；十五络脉（C错）加强了表里两经的联系；奇经八脉（E错）主要有以下作用：统帅、主导；沟通、联络；蓄积、渗灌。